并开药名是指将2～3种疗效相似或有协同作用的饮片缩写在一起而构成的处方名称。“炒三仙”调配时应给付的饮片是
A. 炒神曲、炒谷芽、炒山楂
B. 炒神曲、炒麦芽、炒山楂
C. 炒神曲、炒麦芽、炒稻芽
D. 炒麦芽、炒谷芽、炒稻芽
E. 炒稻芽、炒麦芽、炒山楂

正确答案：B。炒神曲、炒麦芽、炒山楂

解析：本题考查的是饮片的并开药名。并开药名是指将2～3种疗效相似或有协同作用的饮片缩写在一起而构成的处方名称。“炒三仙”调配时应给付的饮片是炒神曲、炒麦芽、炒山楂（B对）。并开药名是指将2～3种疗效基本相似或有协同作用的饮片缩写在一起而构成并开药品。这是一种传统的写法。如二母即指知母、浙贝母，二乌即指制川乌、制草乌，荆防即指荆芥、防风等。处方药名：炒三仙，调配应付：炒神曲、炒麦芽、炒山楂。